急性弥漫性腹膜炎手术治疗的步骤不包括
A. 关腹前均在腹腔内用抗生素控制感染
B. 用生理盐水冲洗腹腔至清洁
C. 寻找引起腹膜炎的原发灶
D. 术后一般放置腹腔引流管
E. 根据病变脏器的部位确定手术切口

正确答案：A。关腹前均在腹腔内用抗生素控制感染

解析：急性弥漫性腹膜炎手术治疗的步骤有四点：①原发病的处理：根据病变脏器的部位确定手术切口（E对），不能确定病变脏器的可做右旁正中切口，开腹后可向上下延长，如曾作过腹部手术，可经原切口或在其附近作切口，探查时要细致轻柔，明确腹膜炎的病因后（C对），决定处理方法；②彻底清洁腹腔：可用甲硝唑及生理盐水冲洗腹腔至清洁（B对），关腹前一般不在腹腔内应用抗生素（A错，为本题正确答案），以免造成严重粘连；③充分引流（D对）：将腹腔内的残留液和继续产生的渗液通过引流管排出体外，以减轻腹腔感染和防止术后发生腹腔脓肿；④术后处理：继续禁食、胃肠减压、补液、应用抗生素和营养支持治疗，保证引流管通畅。